牙齿受酸侵蚀，硬组织发生进行性丧失，称为
A. 龋病
B. 牙隐裂
C. 楔状缺损
D. 酸蚀症
E. 氟斑牙

正确答案：D。酸蚀症

解析：酸蚀症是牙齿受酸侵蚀，硬组织发生进行性丧失的一种疾病。掌握“酸蚀症”知识点。